注射用硫喷妥钠应制衍生物后的物理常数是
A. 比旋度
B. 熔点
C. 折光率
D. 吸收系数
E. 相对密度

正确答案：B。熔点

解析：本题考查巴比妥类药物的分析。注射用硫喷妥钠制备衍生物测定熔点（B对）：硫喷妥钠盐易溶于水，而其游离酸难溶于水的特点，制备游离酸沉淀，过滤、干燥后，测定熔点，以进行鉴别。